患者，女，66岁。近日发现口腔溃烂，影响进食，检查见下唇、两颊黏膜充血，局部形成糜烂，糜烂面上覆有一层灰白色假膜，假膜较厚微突出黏膜表面，致密光滑。擦去假膜，可见溢血的糜烂面。患者进食疼痛。淋巴结肿大压痛，白细胞增高，患者体温增高，且有特殊炎性口臭。治疗该病可选用的药物是
A. 多抗甲素
B. 泼尼松
C. 干扰素或转移因子
D. 酮康唑
E. 抗生素药物

正确答案：E。抗生素药物

解析：①控制感染：感染程度较严重或伴有全身感染症状者应尽量做细菌学检查和药敏试验，根据药敏试验结果选择具有针对性的抗菌药物。根据不同的感染类型、病情轻重程度、微生物检查结果、宿主的易感性等情况选择用药方式、用药剂量及疗程。②补充维生素：维生素B110mg、维生素B25mg、维生素C100mg，每日3次。③中药治疗：可选有清热解毒作用的药物，如银翘散、导赤散、清胃散和清瘟败毒饮等。若有口渴思饮、心烦便秘、小便黄少等心脾积热症状，可口服口炎宁颗粒剂，每次1～2包。④局部治疗：聚维酮碘漱口液含漱15秒钟，每6小时1次或0.2%氯已定漱口液含漱1分钟，每6小时1次。西地碘片1.5mg含化，每天4～6次，可具有广谱杀菌收敛作用；溶菌酶片20mg含化，每天4～6次，有抗菌抗病毒作用；地喹氯铵含片0.5mg含化，每天4～6次，有抗菌、收敛、止痛作用。掌握“球菌性口炎”知识点。